最容易引起出血性膀胱炎的抗癌药是
A. 5-氟尿嘧啶
B. 环磷酰胺
C. 博来霉素
D. 多柔比星
E. 紫杉醇

正确答案：B。环磷酰胺